女，42岁。劳力性胸闷、气促3年，胸骨左缘第3肋间闻及收缩期杂音。首选的检查是
A. X线检查
B. 胸部CT
C. 心电图
D. 冠脉造影
E. 超声心动图

正确答案：E。超声心动图

解析：患者中年女性，有劳力性胸闷、气促症状，胸骨左缘第3肋间（主动脉瓣第二听诊区）闻及收缩期杂音，考虑诊断为主动脉瓣狭窄。故首选的检查是超声心动图（E对）。X线检查（A错）仅能反应心脏外形变化，对瓣膜病变有一定间接提示意义。胸部CT（B错）价格较贵，操作较繁琐，对诊断主动脉狭窄意义不大。心电图（C错）仅能反映心电活动的变化，不能诊断瓣膜狭窄。冠脉造影（D错）主要用于冠心病的确诊。